牛奶不适合婴儿生长发育需要是因其
A. 酪蛋白与乳清蛋白比例与人乳相反
B. 饱和脂肪酸与不饱和脂肪酸比例与人乳相反
C. n-3与n-6比例与人乳相反
D. 缺乏核黄素
E. 缺乏铁

正确答案：A。酪蛋白与乳清蛋白比例与人乳相反